舍格伦综合征的临床症状不包括
A. 口干
B. 腮腺肿大
C. 类风湿性关节炎
D. 干燥性角、结膜炎
E. 睾丸炎或附件炎

正确答案：E。睾丸炎或附件炎

解析：睾丸炎是男性生殖系统的常见炎症，可由多种致病因素引起的睾丸炎性病变，感染途径以血行和淋巴管途径多见，也可由尿道、精囊、输精管、附睾逆行侵入睾丸。女性内生殖器官中，输卵管、卵巢被称为子宫附件。附件炎是指输卵管和卵巢的炎症。不是舍格伦综合征的临床症状。掌握“舍格伦综合征”知识点。